能保持相对较高的免疫原性，适用人群为6月龄以上儿童和成人的疫苗是
A. 亚单位疫苗
B. 裂解疫苗
C. 全病毒灭活疫苗
D. 减毒活疫苗
E. 流感病毒基因工程疫苗

正确答案：B。裂解疫苗

解析：本题考查流感病毒的疫苗种类。裂解型流感疫苗（B对ACDE错）可降低全病毒灭活疫苗的接种不良反应，并保持相对较高的免疫原性，适用人群为6月龄以上儿童和成人。